某男，48岁。因口渴多饮、多食、多尿、腰膝酸次、四肢乏力等不适症状就诊，近2月来体重下降5kg，相关检查显示随机血糖15mmol/L，HbA₁c8.5%，临床诊断为2型糖尿病。医师开具格列本脲，执业药师进行用药指导时，建议不要自行同服含有相同西药成分的中成药。下列药物中含有格列本脲的是
A. 十味玉泉胶囊
B. 金芪降糖片
C. 消糖灵胶囊
D. 糖脉康胶囊
E. 渴乐宁胶囊

正确答案：C。消糖灵胶囊

解析：本题考查的是含西药组分的中成药。下列药物中含有格列本脲的是消糖灵胶囊（C对）。消糖灵胶囊：功能益气养阴，清热泻火。用于阴虚燥热、气阴两虚所致的消渴病，症见口渴喜饮、体倦乏力、多食、多尿、消瘦。含西药成分：格列本脲。十味玉泉胶囊（A错）、金芪降糖片（B错）、糖脉康胶囊（D错）与渴乐宁胶囊（E错）的药物组成，2022年考试指南未明确说明。